男孩，2岁。智力和生长发育落后，经常便秘。查体：身高70cm，皮肤粗糙，鼻梁低平。舌常伸出口外，为明确诊断首选检查
A. 血钙测定
B. 骨龄测定
C. 血T₃、T₄、TSH检测
D. 血氨基酸分析
E. 染色体核型分析

正确答案：C。血T₃、T₄、TSH检测

解析：本例患儿皮肤粗糙、鼻梁低平、舌常伸出口外，经常便秘，智力生长发育落后，应初步诊断为先天性甲低，血T3、T4、TSH检测（C对）可明确诊断。血钙测定（A错）、骨龄测定（B错）、血氨基酸分析（D错）、染色体核型分析（E错）均不用于诊断先天性甲状腺功能减退症。